以下哪个结构不位于肱骨
A. 外科颈
B. 桡神经沟
C. 尺神经沟
D. 转子间嵴
E. 鹰嘴窝

正确答案：D。转子间嵴

解析：转子间嵴是股骨的结构（D错，为本题正确答案）。外科颈（A对）、桡神经沟（B对）、尺神经沟（C对）、鹰嘴（E对）窝均属于肱骨的结构。